牙齿松动与下述哪项因素关系不大
A. 牙槽骨吸收
B. 创伤
C. 牙周韧带的急性炎症
D. 女性激素水平变化
E. 牙龈重度炎症

正确答案：E。牙龈重度炎症

解析：本题考查牙齿松动的原因。牙龈重度炎症（E错，为本题的正答案）时只要牙槽骨未吸收牙齿一般无松动。在生理状态下，牙有一定的动度，在病理情况下，牙松动超过生理范围，这是牙周炎的主要临床表现之一。引起牙松动的原因有（一）牙槽嵴吸收（A对）：牙槽嵴的吸收使牙周支持组织减少，是牙松动最主要的原因。（二）（牙合）创伤（B对）：当患有牙周炎的牙齿同时伴有创伤时，可以使动度明显加重。（三）牙周膜的急性炎症（C对）：如急性根尖周牙或牙周脓肿等可使牙明显松动。（四）牙周翻瓣术后：由于手术的创伤及部分骨质的去除，组织水肿，牙齿有暂时性动度增加。（五）女性激素水平变化（D对）：妊娠期、月经期及长期口服激素类避孕药的妇女可有牙齿动度增加。